男，48岁，颈增粗20年，近一年消瘦10公斤，并有心悸。体检发现双侧甲状腺多个结节。基础代谢率+31%，2小时内甲状腺摄碘29%。最有效的治疗是
A. 长期抗甲状腺药物治疗
B. 手术治疗
C. 放射治疗
D. 甲状腺素治疗
E. 中医治疗

正确答案：B。手术治疗

解析：甲状腺功能亢进症的手术指征为：①继发性甲亢或高功能腺瘤；②中度以上的原发性甲亢；③腺体较大，伴有压迫症状，或胸骨后甲状腺肿等类型甲亢；④抗甲状腺药物或碘131治疗后复发者或坚持长期用药有困难者。⑤妊娠早、中期的甲亢病人凡具有上述指征者，应考虑手术治疗，并可以不终止妊娠。该患者诊断考虑为结节性甲状腺肿继发甲亢，存在手术治疗的指征，最有效的治疗方法为手术治疗（B对）。继发性甲亢，长期抗甲状腺药物治疗（A错）及放射治疗（C错）的效果都不甚显著，同时还存在恶变的可能，应以手术治疗为主（七版黄家驷外科学P1130）。甲状腺素治疗（D错）常用于甲状腺功能减退的替代治疗。中医治疗（E错）多用于辅助治疗。